属中国药典附录内容的有
A. 制剂通则
B. 计量单位使用的有关规定
C. 中文、汉语拼音、拉丁名索引
D. 对照品与对照药材
E. 药材炮制通则

正确答案：A、D、E。制剂通则；对照品与对照药材；药材炮制通则

解析：本题考查《中国药典》的构成。属中国药典附录内容的有制剂通则（A对）、对照品与对照药材（D对）、药材炮制通则（E对）。《中国药典》的构成：《中国药典》由凡例、正文、通则构成。凡例：（1）名称与编排：药材和饮片名称包括中文名、汉语拼音及拉丁名，其中药材和饮片拉丁名排序为属名或属名加种加词在先，药用部位在后；植物油脂和提取物、成方制剂和单味制剂名称不设拉丁名。正文分为药材和饮片、植物油脂和提取物、成方制剂和单味制剂三部分。三个部分分别按中文名笔画顺序排列，同笔画数的字按起笔笔形一、丨、丿、乛的顺序排列；单列的饮片排在相应药材的后面；制剂中同一正文项下凡因规格不同而致内容不同需单列者，在其名称后加括号注明；附录（包括制剂通则、通用检测方法和指导原则）按分类编码。索引分别按中文索引、汉语拼音索引、拉丁名索引和拉丁学名索引顺序排列（C错）。（2）对照品、对照药材、对照提取物、标准品。（3）精确度：取样量的准确度和试验精密度（B错）。